可用于包合物制备的方法是
A. 饱和水溶液法
B. 复凝聚法
C. 熔融法
D. X射线衍射法
E. 热分析法

正确答案：A。饱和水溶液法

解析：本题考查环糊精包合技术包合物的制备。可用于包合物制备的方法是饱和水溶液法（A对）。环糊精包合技术包合物的制备方法：饱和水溶液法、研磨法、超声波法、冷冻干燥法、喷雾干燥法。微囊制备技术微囊的制备：物理化学方法为单凝聚法与复凝聚法（B错）；物理机械法为喷雾干燥法与空气悬浮法；化学法为界面缩聚法与辐射交联法。固体分散技术固体分散体的制备方法：熔融法（C错）、溶剂法（共沉淀法或共蒸发法）、溶剂-熔融法、溶剂-喷雾（冷冻）干燥法、研磨法、双螺旋挤压法。环糊精包合技术质量评价：薄层色谱法、X射线衍射法（D错）、热分析法（E错）、显微镜法、红外光谱法、核磁共振谱法、荧光光谱法、圆二色谱法。